除解表退热外，又能疏肝的药是
A. 柴胡
B. 葛根
C. 升麻
D. 蔓荆子
E. 淡豆豉

正确答案：A。柴胡

解析：本题考查的是柴胡的功效。除解表退热外，又能疏肝的药是柴胡（A对）。柴胡：【功效】解表退热，疏肝解郁，升举阳气。葛根（B错）：【功效】解肌退热，透疹，生津，升阳止泻。升麻（C错）：【功效】发表透疹，清热解毒，升举阳气。蔓荆子（D错）：【功效】疏散风热，清利头目，祛风止痛。淡豆豉（E错）：【功效】解表，除烦。